患者，女，27岁，孕8周，身高168cm，体重58kg，因体检尿常规结果异常就诊，白细胞300/μl。今日尿培养回报：尿细菌计数2.13×10⁵cfu/ml，患者自述无尿频、尿急、尿痛，无肉眼可见血尿，无腰痛、寒战或发热。关于该患者治疗方案的说法，正确的是
A. 不需要抗感染治疗，患者没有尿路刺激症状
B. 需要抗感染治疗，否则可增加早产或低出生体重儿发生概率
C. 不需要抗感染治疗，药物可增加胎儿畸形风险
D. 不需要抗感染治疗，是自限性疾病
E. 需要抗感染治疗，否则可导致孕妇发生败血症

正确答案：B。需要抗感染治疗，否则可增加早产或低出生体重儿发生概率

解析：本题考查妊娠期无症状菌尿治疗。妊娠期无症状菌尿，需要抗感染治疗，否则可增加早产或低出生体重儿发生概率（B对）。妊娠期无症状菌尿是首个被明确与围产期不良结局密切相关的亚临床感染之一，其导致早产儿或低出生体重儿的概率增加20～30倍。